大肠埃希菌分裂一代需要的时间大约是
A. 18小时
B. 20分钟
C. 72小时
D. 60分钟
E. 20秒

正确答案：B。20分钟